内含动脉血的静脉是
A. 头臂静脉
B. 上腔静脉
C. 肺静脉
D. 板障静脉
E. 冠状窦

正确答案：C。肺静脉

解析：肺静脉（C对）内含动脉血，肺静脉及其分支将含氧量高的血液输送到左心房。